根据《药品经营质量管理规范》药品出库应遵循的原则是
A. 先进先出，近期先出，按批号发货
B. 先产先出，近期先出，按批号发货
C. 先进先出，按批号发货
D. 先产先出，按批号发货
E. 近期先出，按批号发货

正确答案：B。先产先出，近期先出，按批号发货

解析：本题考查有效期药品管理。购进药品验收时应注意该药品入库要按批号堆放或上架，出库必须贯彻“先产先出、近期先出，按批号发货”（B对）的原则。